女，23岁，未婚，外阴瘙痒，白带增多5天。追问病史有不洁性交史。妇科检查：外阴皮肤、黏膜充血，小阴唇内侧见多个小菜花状赘生物，宫颈轻度糜烂，子宫正常大，附件无明显异常。本例可能的诊断为
A. 梅毒
B. 假丝酵母菌性阴道炎
C. 淋病
D. 尖锐湿疣
E. 滴虫阴道炎

正确答案：D。尖锐湿疣